下列哪项是脾脏肿大和腹腔肿块的主要鉴别点
A. 有无压痛
B. 有无切迹
C. 质地的软硬
D. 活动度的大小
E. 叩诊音的差异性

正确答案：B。有无切迹

解析：腹部包块是指在腹部检查时可触及到的异常包块，常见的原因有脏器肿大，空腔脏器膨胀，组织增生，炎症粘连及良恶性肿瘤等。腹部包块主要依靠触诊检查。触诊如果发现肿块应注意肿块的位置、大小、形态、质地（C错）、有无压痛（A错）及移动度（D错），借此来鉴别肿块的来源和性质。脾脏明显肿大时可有切迹（B对），故有无切迹是脾脏肿大和腹腔肿块的主要鉴别点。脾脏肿大和腹部肿块的叩诊音都成实音，故不是脾脏肿大和腹腔肿块的主要鉴别点。